以下关于超敏反应分型的说法正确的是
A. Ⅰ型超敏反应IgG或IgM抗体引起的病理性免疫反应
B. Ⅱ型超敏反应时由于免疫复合物引起的炎症反应
C. Ⅲ型超敏反应又称为速发型超敏反应
D. Ⅳ型超敏反应又称为迟发型超敏反应
E. Ⅴ型超敏反应过程中有中性粒细胞参与

正确答案：D。Ⅳ型超敏反应又称为迟发型超敏反应

解析：超敏反应分为Ⅰ、Ⅱ、Ⅲ、Ⅳ型。Ⅰ型超敏反应又称速发型超敏反应；Ⅱ型超敏反应是由IgG或IgM抗体引起的以细胞溶解和组织损伤为主的病理性免疫反应；Ⅲ型超敏反应是由免疫复合物引起的炎症反应和组织损伤；Ⅳ型超敏反应又称迟发型超敏反应。掌握“概述及Ⅰ型超敏反应”知识点。